血府逐瘀汤组成中含有的药物是
A. 当归，枳壳
B. 当归，人参
C. 人参，川芎
D. 当归，苍术
E. 山药，白术

正确答案：A。当归，枳壳

解析：本题考查血府逐瘀汤的组成，记忆即可。血府逐瘀汤由桃仁、红花、当归、生地黄、牛膝、川芎、桔梗、赤芍、枳壳、甘草、柴胡组成（A对）。趣记：桃红四物+枳柴桔+牛膝。